下列属于补体系统的激活的途径是
A. 旁路途径
B. 经典途径
C. 凝集素途径
D. A+B
E. A+B+C

正确答案：E。A+B+C

解析：补体系统的激活的途径：旁路途径、经典途径、凝集素途径。掌握“补体的概念，激活途径及调节”知识点。